在队列研究中不会出现的偏倚是
A. 错分偏倚
B. 奈曼偏倚
C. 失访偏倚
D. 混杂偏倚
E. 信息偏倚

正确答案：B。奈曼偏倚

解析：奈曼是病例对照研究会出现的偏倚